突触前抑制的产生是由于
A. 突触前轴突末梢超极化
B. 突触前轴突末梢去极化
C. 突触后膜的兴奋性发生改变
D. 突触前轴突末梢释放抑制性递质
E. 突触后神经元超极化

正确答案：B。突触前轴突末梢去极化